男，42岁。进油腻饮食后腹胀、腹痛4小时。持续性上腹痛，伴有恶心、呕吐、发热、腰背部不适。查体：T38.4C，P124次/分，BP90/60mmHg，急性痛苦貌，巩膜无黄染，腹饱满，全腹肌紧张，有压痛和反跳痛，上腹为主，肠鸣音消失。右下腹穿刺抽出淡红色血性液体。血WBC16.2×10⁹/L，N0.9。血清淀粉酶6000U/L（Somogyi法）。出现这种病变的主要发病机制是
A. 细菌侵入胰周围和胰腺内
B. 胰腺供血动脉栓塞引起供血障碍
C. 穿透性十二指肠溃疡导致胰腺炎性反应
D. 胆囊炎、胆囊结石堵塞胆囊管，梗阻
E. 胰腺中的消化酶被激活后导致胰腺自身消化

正确答案：E。胰腺中的消化酶被激活后导致胰腺自身消化

解析：患者进食油腻食物后感上腹持续性疼痛，腹膜刺激征阳性，右下腹穿刺抽出血性液体，血清淀粉酶＞500U/L（Somogyi法），根据患者的既往史、临床表现和实验室诊断，可确诊为急性胰腺炎。急性胰腺炎是由于胆胰管共同通路受阻，胰液排出障碍，胰管内高压，导致胰腺腺泡细胞破裂，胰液外溢，胰酶被激活导致的自身消化（E对）。细菌侵入胰周围和胰腺内（A错）、胰腺供血动脉栓塞引起供血障碍（B错）、穿透性十二直肠溃疡导致胰腺炎性反应（C错）、胆囊炎、胆囊结石堵塞胆囊管，引起胰管梗阻（D错）均为引起急性胰腺炎的病因，而不是发病机制。